患者，男，22岁。发热恶寒，寒重热轻，头痛身痛，鼻塞流涕，咳嗽，咳痰清稀，舌苔薄白，脉浮紧。治疗应首选
A. 手太阴、手阳明、足太阳经穴
B. 手少阴、手太阳、手太阴经穴
C. 手太阴、足太阳、手少阳经穴
D. 手太阴、手少阳、足少阳经穴
E. 手阳明、足阳明、手太阴经穴

正确答案：A。手太阴、手阳明、足太阳经穴

解析：该患者的症状可知本病为感冒之风寒感冒,治以祛散风寒表邪为主。所以应首选手太阴肺经疏风散寒;手阳明大肠经与肺经相表里，所以其经穴能协助肺经经穴疏风散寒；督脉主一身之阳气，温灸大椎可通阳散寒。（A对）。手少阴心经腧穴主治心、胸、神志及经脉循行部位的其他病证，手太阳小肠经腧穴主治头面五官病、热病、神志病及经脉循行部位的其他病证（B错）。手少阳三焦经腧穴主治头、目、耳、颊、咽喉、胸胁病和热病，以及经脉循行经过部位的其他病证（C错）。足少阳胆经腧穴主治肝胆病，侧头、目、耳、咽喉、胸胁病，以及经脉循行经过部位的其他病证（D错）。足阳明胃经腧穴主治胃肠病、头面五官病、神志病、皮肤病、热病及经脉循行经过的其他病证（E错）。